临床区别颌下腺肿块与颌下淋巴结的主要方法是
A. 探诊
B. 听诊
C. 望诊
D. 叩诊
E. 口内外双合诊

正确答案：E。口内外双合诊

解析：颌下腺肿块在口内、外触诊都有感觉，颌下淋巴结在口内不容易触诊出来。需行口内外双合诊检查。掌握“口外一般检查及辅助检查”知识点。